丙二酸或戊二酸对于琥珀酸脱氢酶的影响属于
A. 反馈抑制
B. 底物抑制
C. 竞争性抑制
D. 非竞争性抑制
E. 变构调节

正确答案：C。竞争性抑制

解析：有些可逆性抑制剂与底物结构相似，能和底物竞争酶的活性中心，使酶不能与底物结合，抑制酶促反应，称为竞争性抑制。琥珀酸脱氢酶可催化琥珀酸的脱氢反应，却不能催化丙二酸或戊二酸发生脱氢反应。但二者与琥珀酸结构类似，均为琥珀酸脱氢酶的竞争性抑制剂。掌握“辅酶与酶促反应”知识点。